戊型肝炎
A. 主要传播途径为经血传播、母婴传播、性传播
B. 发病多见于儿童
C. 周期性明显
D. 主要经水、食物及日常生活接触传播
E. 孕妇罹患率高，病死率高

正确答案：D。主要经水、食物及日常生活接触传播

解析：本题考查戊型肝炎的相关内容。戊肝主要主要经水、食物及日常生活接触传播（D对A错）。戊型肝炎主要为青壮年发病，儿童和老年发病相对较少（B错），男性发病率高于女性。戊型肝炎有明显的季节性（C错），多发生于雨季和夏季。孕妇在孕晚期发生戊肝后病死率高（E错），并且常会导致流产、产儿低体重和死胎。